男性，45岁。肝炎病史20余年，近2月来出现右侧季肋部持续胀痛，伴厌食、乏力和腹胀。查体：右侧肋缘下可触及到肿大的肝脏，质地坚硬，边缘不规则；AFP＞1000μg/L。首先考虑的疾病是
A. 肝硬化
B. 慢性肝炎活动期
C. 原发性肝癌
D. 细菌性肝脓肿
E. 肝脏血管瘤

正确答案：C。原发性肝癌

解析：患者AFP（甲胎蛋白）＞1000μg/L（正常＜25μg/L），AFP是肝癌肿瘤标志物，结合长期肝炎病史，肝大、肝区疼痛的体征，首先应考虑原发性肝癌（C对）。肝硬化（A错）主要表现为肝功能降低和门静脉高压；慢性肝炎活动期（B错）以乏力、食欲减退等肝炎表现为主；细菌性肝脓肿（D错）起病急，主要表现寒战、高热等症状；肝脏血管瘤（E错）属于良性肿瘤，多产生压迫胃、十二指肠等邻近器官的症状，以上疾病均不出现AFP增高。